患儿，3岁。壮热不退，气急鼻煽，张口抬肩，摇身撷肚，口唇发绀，胸闷腹胀，大便秘结。治疗应在正确选方的基础上加
A. 黄芩、连翘
B. 天竺黄、全瓜蒌
C. 丹参、红花
D. 牛黄夺命散
E. 桑白皮、沉香末

正确答案：D。牛黄夺命散

解析：患儿，3岁。壮热不退，气急鼻煽，张口抬肩，摇身撷肚，口唇发绀，考虑为肺炎喘嗽之极期的痰热闭肺证。痰热闭阻肺络气道则证见壮热不退、气急鼻煽，张口抬肩，摇身撷肚等症状。胸闷腹胀，大便秘结，说明病情较急而又腹气不通，加重了肺炎闭塞的程度。治当釜底抽薪，通过泻大肠而达到泻肺火之目的，故宜在正确选用五虎汤合葶苈大枣泻肺汤的基础上，再合用牛黄夺命散（D对）。黄芩、连翘清热解毒（A错）。天竺黄有祛风除湿，活血舒经，止咳的功效，全瓜蒌清热涤痰，宽胸散结，润燥滑肠（B错）。丹参活血祛瘀，通经止痛，清心除烦，凉血消痈，红花活血通经，祛瘀止痛（C错）。桑白皮、沉香末行气止痛，温中止呕，纳气平喘（E错）。